20世纪90年代。某地水源污染引发一起传染病爆发流行。在80万人的供水范围内，40.3万人罹患经自来水传播的隐孢子病。此次突发公共卫生事件突出体现的特点是
A. 局限性
B. 普遍性
C. 常规性
D. 散发性
E. 聚集性

正确答案：B。普遍性

解析：突发公共卫生事件的特点有突发性、普遍性、非常规性。突发性是指发生突然，出乎意料。它一般不具备事物发生前的征兆，留给人们的思考余地较小，要求人们必须在极短的时间内做出分析、判断。非常规性是指突发公共卫生事件超出了一般社会卫生危机的发展规律，并呈现出易变特性，有的甚至呈“跳跃式”发展。普遍性（B对）是指突发公共卫生事件影响的区域比较广，涉及的人员比较多，往往引起“多米诺骨牌”效应。该突发事件涉及范围广、涉及人员多，故体现了突发公共卫生事件的普遍性。局限性（A错）、常规性（C错）、散发性（D错）、聚集性（E错）均不是突发公共卫生事件的特点。